男，28岁，背部刀割伤1小时急诊。查体：P100次/分，R25次/分，BP90/60mmHg，面色略苍白，左侧脊柱旁可见长约3cm伤口，有空气进出声响，未见血液外溢，胸部X线片可见少量液气胸，此时最佳处理措施是
A. 气管插管，呼吸机支持
B. 开腹探查
C. 吸氧
D. 封闭伤口，胸腔闭式引流
E. 清创缝合

正确答案：D。封闭伤口，胸腔闭式引流

解析：青年男性患者，背部刀割伤，查体：P100次/分（正常值为60～100次/分），R25次/分（正常值为16～20次/分，呼吸增快），BP90/60mmHg（正常值为90～140/60～90mmHg），面色略苍白，左侧脊柱旁可见长约3cm伤口，有空气进出声响（开放性气胸的特征性体征），未见血液外溢，胸部X线片可见少量液气胸，根据该患者的临床症状、体征及影像学表现，考虑最可能的诊断为开放性气胸合并血胸，此时最佳的处理措施是封闭伤口，胸腔闭式引流（D对），赢得挽救生命的时间，防止病情进一步加重。若没有封闭伤口，即使行气管插管，呼吸机支持（A错）也不会使病情得到改善。如同时伴有腹腔内脏器损伤或进行性出血，应开腹探查（B错）。吸氧（C错）、清创缝合（E错）为病情稳定后的进一步的处理措施。